为了解病毒性肝炎在某地区的分布情况，研究者于2019年7月进行抽样调查部分结果如下共调查10000，男6000人女4000人，发现患者1000人，女性300人（乙肝200例，丙肝50例，其他50例），调查还发现在600例乙肝患者中有300例是2019年新发。该研究方法为
A. 分析性
B. 理论性研究
C. 描述性研究
D. 实验性研究
E. 生态学研究

正确答案：C。描述性研究

解析：描述性研究常见类型主要有：现状研究（横断面研究）（C对）、生态学研究（E错）、病例报告、病例系列分析、个案研究、历史资料分析、比例死亡比研究等。实验性研究是研究者根据研究目的，主动对受试对象施加千预措施的研究（D错）。理论性研究，也称基础性研究（B错）。